具有非特异性杀伤作用的细胞是
A. Th细胞
B. CTL细胞
C. TCRαβT细胞
D. NK细胞
E. Ts细胞

正确答案：D。NK细胞